结合上皮向根方增殖，延伸，形成深牙周袋，是以下哪项病理表现
A. 牙周炎静止期
B. 牙周炎活动期
C. 牙周变性
D. 牙周创伤
E. 牙周萎缩

正确答案：B。牙周炎活动期

解析：本题考查活动期牙周炎的病理变化。结合上皮向根方增殖，延伸，形成深牙周袋，是牙周炎活动期（B对）的病理表现。牙周炎活动期的病理变化包括结合上皮向根方增殖，延伸，形成深牙周袋，其周围有大量炎症细胞浸润这一特点。